患者男性18岁，右下颌角隆起，右下8未萌出，右下87舌侧膨隆明显肿物，X线显示右下765根尖下方5.0cm×3.0cm圆形低密度影，边界清楚，沿颌骨长轴发展。术前对诊断最有帮助的检查是
A. 活检
B. 曲面断层片
C. 根尖片
D. 穿刺
E. CT检查

正确答案：D。穿刺

解析：本题考查牙源性颌骨囊肿。穿刺（D对）对于牙源性角化囊性瘤的诊断比较可靠，大多可见黄、白色角蛋白样（皮脂样）物质混杂其中。将抽出物做角蛋白染色检查有助于对角化囊性瘤的诊断。